黑质纹状体系统内使左旋多巴转化为多巴胺的酶是
A. 单胺氧化酶
B. 氨基酸脱羧酶
C. 酪氨酸羟化酶
D. 儿茶酚胺邻甲基转移酶
E. 胆碱脂酶

正确答案：B。氨基酸脱羧酶

解析：氨基酸脱羧酶（B对）在黑质纹状体系统内使左旋多巴转化为多巴胺，产生治疗效果。单胺氧化酶（A错）为催化单胺氧化脱氨反应的酶，可催化儿茶酚胺类的物质脱氨、去活性。酪氨酸在肾上腺髓质和神经组织经酪氨酸羟化酶（C错）催化生成多巴。儿茶酚胺邻甲基转移酶（D错）可降解体内儿茶酚胺，它的抑制剂可以延长多巴胺半衰期，使更多左旋多巴进入脑组织。胆碱脂酶（E错）水解乙酰胆碱，用于解救有机磷酸酯类中毒。